氯化物检查法中使用的试剂有
A. 稀硝酸
B. 25%氯化钡溶液
C. 硫代乙酰胺试液
D. 碘化钾试液
E. 硝酸银试液

正确答案：A、E。稀硝酸；硝酸银试液

解析：本题考查药物的配伍变化。氯化物检查法中使用的试剂有稀硝酸（A对）和硝酸银试液（E对）。氯化物检查法是利用氯化物在硝酸酸性溶液中与硝酸银试液作用，生成氯化银的白色浑浊液，与一定量标准氯化钠溶液在相同条件下生成的氯化银浑浊液比较，以判断供试品中的氯化物是否超过限量。氯化钡溶液本身还有氯离子，不可用于氯化物的检查。钡离子可与硫酸根离子产生沉淀，故25%氯化钡溶液（B错）可用于检查硫酸根离子。重金属杂质（以铅为代表）可在pH3.5的醋酸盐缓冲液中与显色剂硫代乙酰胺反应呈黄色至棕黑色，故硫代乙酰胺试液（C错）常用于检测重金属杂质。碘化钾试液（D错）作为还原剂进行氧化还原滴定。